影响脂肪、蛋白质等大分子物质转运，可使药物避免肝脏首过效应而影响药物分布的因素是
A. 血浆蛋白结合率
B. 血脑屏障
C. 肠肝循环
D. 淋巴循环
E. 胎盘屏障

正确答案：D。淋巴循环

解析：本题考查淋巴循环。影响脂肪、蛋白质等大分子物质转运，可使药物避免肝脏首过效应而影响药物分布的因素是淋巴循环（D对）；血浆蛋白结合率（A错）决定药物游离型和结合型浓度的比例，既可影响药物体内分布也能影响药物代谢和排泄；血脑屏障（B错）是血液与脑组织之间的屏障，脑组织对外来物质有选择地摄取，使药物不易透过，影响药物进入中枢神经发挥作用；肠肝循环（C错）是指随胆汁排入十二指肠的药物或其代谢物，在肠道中重新被吸收，经门静脉返回肝脏，重新进入血液循环的现象；胎盘屏障（E错）是由胎盘绒毛与子宫血窦构成的，将母体与胎儿血液隔开的屏障。